为早期发现溃疡恶性病变，检查时应注意的事项中，除外的是
A. 边缘是否整齐
B. 有无假膜形成
C. 是否向四周浸润
D. 基底部有无硬结
E. 愈合后是否留下瘢痕

正确答案：E。愈合后是否留下瘢痕

解析：溃疡是多种多样的，大小、数目、深浅均不一。检查溃疡时要注意边缘是否整齐，有无倒凹；溃疡面有无假膜形成；底部是平坦，还是有颗粒结节；基底部有无硬结；是否向四周浸润。这些现象对于确定诊断及分析黏膜病特别是早期发现恶性病变都很重要。浅层溃疡只破坏上皮层，愈合后不留瘢痕，如复发性阿弗他溃疡。而深层溃疡则病变波及黏膜下层，痊愈后遗留瘢痕，如复发性坏死性黏膜腺周围炎。掌握“口腔黏膜基本病理变化”知识点。